下列哪种不是气态污染物的处理方法
A. 捕集
B. 催化
C. 燃烧
D. 冷凝
E. 吸附

正确答案：A。捕集

解析：本题考查气态污染物的处理方法。气态污染物是在常态、常压下以分子状态存在的污染物。常见的气体污染物有：CO、SO₂、NO₂等。气态污染物根据污染物的化学和物理性质，可采用吸收、吸附（E对）、催化（B对）、冷凝（D对）和燃烧（C对）等处理方法。捕集（A错，为本题正确答案）是颗粒物的治理技术。